因水与极性分子剧烈运动与相互摩擦导致迅速升温而杀灭微生物的灭菌方法是
A. 微波灭菌
B. 紫外线灭菌
C. Coγ-射线灭菌
D. 热压灭菌
E. 环氧乙烷灭菌

正确答案：A。微波灭菌

解析：本题考查的是微波灭菌。因水与极性分子剧烈运动与相互摩擦导致迅速升温而杀灭微生物的灭菌方法是微波灭菌（A对）。微波干燥养护法：微波干燥依赖于微波加热。微波加热利用的是介质损耗原理，物料中的水分子是极性分子，且水是强烈吸收微波的物质，在微波作用下，其极性取向随外电磁场的变化而变化，致使分子急剧摩擦碰撞，使物料产生热化和膨化等一系列过程而达到加热目的，在此过程中，水分子由物料内部向表面移动，变成水蒸气而被排走，从而迅速完成干燥。Coγ-射线灭菌（C错）：应用放射性⁶⁰Co产生的γ射线或加速产生的β射线辐照药材时，附着的霉菌、害虫吸收放射能和电荷，很快引起分子电离，从而产生自由基。这种自由基经由分子内或分子间的反应过程，诱发射线化学的各种过程，使机体内的水、蛋白质、核酸、脂肪和碳水化合物等发生不可逆变化，导致生物酶失活，生理生化反应延缓或停止，新陈代谢中断，霉菌和害虫死亡。环氧乙烷灭菌（E错）属于包装防霉养护法。包装防霉养护法：即为将无菌包装用于中药材和饮片的包装。首先将中药材或饮片灭菌，然后把无菌的中药材和饮片放进一个霉菌无法生长的环境，这样由于避免了再次污染的机会，在常温条件下，不需任何防腐剂或冷冻设施，在一段时间内不会发生霉变。值得注意的是，进行这种包装时，一定需要包装环境无菌、贮存物无菌及包装容器无菌。无菌包装过程中，对产品及容器的灭菌是一个重要的问题。包装容器的种类很多，用在中药材或饮片的包装，目前绝大部分是采用聚乙烯材料。聚乙烯不宜用蒸汽灭菌，最适宜用环氧乙烷混合气体灭菌。紫外线灭菌（B错）与热压灭菌（D错），2022年考试指南未明确说明。